长途汽车司机属于艾滋病健康教育目标人群中的
A. 高危人群
B. 一般人群
C. 重点人群
D. 社区人群
E. 特殊人群

正确答案：C。重点人群